药师调剂处方时必须做到“四查十对”，“十对”中有一项内容是
A. 对处方
B. 对药品
C. 对药名
D. 对配伍
E. 对用药合理性

正确答案：C。对药名

解析：本题考查的是处方调剂的流程。药师调剂处方时必须做到“四查十对”，“十对”中有一项内容是对药名（C对）。药师调剂处方时必须做到“四查十对”：查处方（A错），对科别、姓名、年龄；查药品（B错），对药名、剂型、规格、数量；查配伍（D错）禁忌，对药品性状、用法用量；查用药合理性（E错），对临床诊断。